下列有关全口义齿排牙组织保健原则，哪项是错误的
A. 前牙切导斜度要大
B. 排牙时切忌排成深覆（牙合）
C. （牙合）平面与鼻翼耳屏线平行
D. 后牙功能尖尽量排在牙槽嵴顶
E. 要求保持义齿各方向的平衡接触

正确答案：A。前牙切导斜度要大

解析：本题考查全口义齿排牙及蜡型试戴。组织保健原则①人工牙的排列要不妨碍舌、唇、颊肌的活动，处于肌肉平衡位置。②（牙合）平面与鼻翼耳屏线平行（C对），其高度位于舌侧外缘最突出处，便于舌头将食物送至后牙面，利于义齿在功能状态下的稳定。③后牙功能尖要尽量排在牙槽嵴顶上（D对），使（牙合）力沿垂直方向传至牙槽嵴。④如果牙槽嵴吸收较多，要根据牙槽嵴斜坡倾斜方向调整后牙倾斜度，使（牙合）力尽可能以垂直方向传至牙槽嵴，如果牙槽嵴严重吸收，则要注意将力最大处放在牙槽嵴最低处，减少义齿在功能状态下的翘动。⑤前牙要排列成浅覆（牙合）、浅覆盖（A错B对，A为本题正确答案），正中（牙合）时前牙不接触。⑥在上下牙齿间自由滑动时，要有平衡（牙合）接触（E对），即前牙对刃接触时，后牙每侧至少一点接触，后牙一侧咬合时，工作侧为组牙接触（尖牙保护不适于全口义齿）非工作侧至少有一点接触。⑦减少功能状态下的不稳定因素，要适当降低非功能尖，如上磨牙颊尖和下磨牙舌尖，减少研磨食物时义齿的摆动。